下列哪项是诊断肺心病的主要依据
A. 肺动脉狭窄
B. 阻塞性肺气肿
C. 长期慢性支气管炎
D. 两下肢浮肿
E. 肺动脉高压及右心室肥大

正确答案：E。肺动脉高压及右心室肥大

解析：肺心病是指由支气管-肺组织、胸廓或肺血管病变致肺血管阻力增加，产生肺动脉高压，继而右心室结构或功能改变的疾病。诊断肺心病的主要依据是肺动脉高压及右心室肥大（E对）。肺动脉狭窄（A错）对诊断先天性心脏病有一定意义。阻塞性肺气肿（B错）、长期慢性支气管炎（C错）对肺心病的诊断有一定意义，但不是诊断肺心病的主要依据。两下肢浮肿（D错）对诊断肾病综合征有一定意义。